巴氏消毒法多用于下列哪种食品
A. 鲜奶
B. 肉类
C. 鱼类
D. 罐头
E. 食用油

正确答案：A。鲜奶